患者易发生遗传性血管神经性水肿的是
A. MPO缺乏
B. NADH/NADPH缺乏
C. MHC-I类分子缺如
D. MHC-II类分子缺如
E. C1-INH缺乏

正确答案：E。C1-INH缺乏

解析：C3缺陷患者易发生严重的致死性化脓菌感染。C1抑制物（C1-INH）的缺陷患者易发生遗传性血管神经性水肿。患者表现为反复发作的皮肤黏膜水肿，若水肿发生于喉头可导致窒息死亡。掌握“免疫缺陷概述及原发性、获得性免疫缺陷病”知识点。